如果根尖周肉芽肿在拔牙后未作适当处理仍残留在颌骨内而发生的囊肿，则称为
A. 残余囊肿
B. 始基囊肿
C. 含牙囊肿
D. 皮样囊肿
E. 滤泡囊肿

正确答案：A。残余囊肿

解析：如果根尖周肉芽肿在拔牙后未作适当处理仍残留在颌骨内而发生的囊肿，则称为残余囊肿。掌握“甲状舌管囊肿及鳃裂囊肿”知识点。